某药的降解反应为一级反应，其反应速度常数k=0.0096天-1，其有效期t0.9是
A. 1天
B. 5天
C. 8天
D. 11天
E. 72天

正确答案：D。11天